下列有关Vmax的叙述中，哪一项是正确的
A. Vmax是酶完全被底物饱和时的反应速度
B. 竞争性抑制时Vm减少
C. 非竞争抑制时Vm增加
D. 反竞争抑制时Vm增加
E. Vm与底物浓度无关

正确答案：A。Vmax是酶完全被底物饱和时的反应速度

解析：酶反应速率与底物浓度密切相关，在酶浓度和其他反应条件不变的情况下，反应速率对底物浓度作图呈矩形双曲线。当底物浓度很低时，速率随底物浓度增加而增加，呈线性关系，随着底物浓度的不断增高，速率上升的幅度不断变缓。当底物浓度达到一定程度时，所有酶的活性中心均被底物所饱和，底物浓度的增高不再加快速率，达到最大速率Vmax。掌握“辅酶与酶促反应”知识点。